患者项部皮损味多角形皮疹融合成片，剧烈瘙痒，搔抓后皮损增厚，皮沟加深，皮脊隆起，形成苔藓样变，诊断是
A. 白疕
B. 圆癣
C. 白秃疮病
D. 红蝴蝶疮病
E. 牛皮癣

正确答案：E。牛皮癣

解析：白疕因其“肤如疹疥，色白而痒，搔起白皮”而得名，其特点是：在红斑上有松散的银白色鳞屑，抓之有薄膜及露水珠样出血点，患者无此表现（A错）。圆癣的皮损特征为环形或多环形、边界清楚、中心消退、外围扩张的斑块，与患者表现不符（B错）。白秃疮皮损特征是在头皮有圆形或不规则的覆盖灰白鳞屑的斑片，病损区毛发干枯无泽，常在距头皮0.3~0.8cm处折断而呈参差不齐，与患者表现不符（C错）。红蝴蝶疮特点是：盘状红蝴蝶疮好发于面颊部，主要表现为皮肤损害，多为局限性；系统性红蝴蝶疮除有皮肤损害外，常同时累及全身托系统、多脏器，患者皮损发生于颈部，与红蝴蝶疮表现不符（D错）。牛皮癣其特点是 皮损多是圆形或多角形的扁平丘疹融合成片，剧烈瘙痒，搔抓后皮损肥厚，皮沟加深，皮嵴隆起，极易形成苔藓样变，符合患者表现（E对）。